男，28岁。受凉后发热、咳嗽、咳痰一周，气促2天，意识模糊一小时。查体：T39.8℃，血压80/50mmHg，口唇发绀，双肺可闻及较多湿啰音，心率109次/分，未闻及杂音，四肢冷。血常规WBC21×10⁹/L，N0.90。该患者经过抗感染等综合治疗后症状有所改善，血压100/60mmHg。动脉血气分析（面罩吸氧5L/分钟）提示：PaO₂50mmHg，PaCO₂28mmHg，HCO₃⁻16mmol/L。此时首选措施是
A. 静脉点滴糖皮质激素
B. 静脉点滴呼吸兴奋剂
C. 静脉点滴丙种球蛋白
D. 静脉点滴碳酸氢钠
E. 机械通气

正确答案：E。机械通气

解析：患者受凉后出现发热、咳嗽、咳痰及气促症状，体温38℃（非感染性疾病一般小于38℃），血压下降，口唇发绀并且双肺出现湿啰音，WBC21×10⁹/L（正常值4～10×10⁹/L），N0.90（正常值0.50～0.70），提示存在感染，以上症状及特征都符合社区获得性肺炎的诊断依据，其中呼吸困难和口唇发绀表明肺炎已达重度，因此本例首选诊断应为重症肺炎。其血气分析提示：PaO₂50mmHg，PaCO₂28mmHg，HCO₃⁻16mmol/L，Ⅰ型呼吸衰竭诊断标准：PaO₂＜60mmHg，PaCO₂降低或正常。HCO₃⁻正常值为22～27mmol/L，表明患者出现Ⅰ型呼吸衰竭并合并酸中毒，此时为了治疗呼吸衰竭及纠正酸中毒，应及时使用机械通气治疗（E对）。静脉点滴糖皮质激素（A错）常用于重症哮喘的治疗，糖皮质激素可以降低机体的免疫力，应用于重症肺炎中会加重症状，故不作为首选。静脉点滴呼吸兴奋剂（B对）常用于中枢抑制为主、通气量不足引起的呼吸衰竭（P144），但是本患者是由于肺炎导致的换气功能障碍，应用呼吸兴奋剂会导致呼吸肌疲劳，所以不作为首选。静脉点滴丙种球蛋白（C错）常用于重症感染性的控制，提高机体免疫力，本患者虽然属于重症感染，但是其呼吸衰竭症状及酸中毒较重，对患者生命威胁更大，故应先治疗患者呼吸系统的症状，因此，静脉点滴丙种球蛋白不作为首选治疗。酸中毒静脉点滴碳酸氢钠的标准为血浆HCO₃⁻低于10mmol/L，本例患者HCO₃⁻16mmol/L，因此无需静脉点滴碳酸氢钠（D错）。